属于乙类传染病但采取甲类传染病预防和控制措施的疾病是
A. 白喉
B. 传染性非典型肺炎
C. 梅毒
D. 新生儿破伤风
E. 百日咳

正确答案：B。传染性非典型肺炎

解析：属于乙类传染病但采取甲类传染病预防和控制措施的疾病是传染性非典型性肺炎（B对）、炭疽中的肺炭疽、人感染高致病性禽流感和脊髓灰质炎。白喉（A错）、传染性非典型肺炎、梅毒（C错）、新生儿破伤风（D错）、百日咳（E错）均属于乙类传染病。